郁李仁的功效是
A. 活血祛瘀
B. 清肝泻火
C. 利水消肿
D. 软坚散结
E. 凉血解毒

正确答案：C。利水消肿

解析：郁李仁质润多脂，润肠通便作用类似火麻仁而力较强，且润中兼可行大肠之气滞，用于津枯肠燥便秘之证；又能利水消肿，治疗水肿胀满，小便不利（C对）。大黄的功效是泻下攻积，清热泻火，活血祛瘀（A错），凉血解毒（E错），利湿退黄。芦荟的功效是泻下通便，清肝泻火（B错）。牡蛎的功效是潜阳补阴，重镇安神，软坚散结（D错），收敛固涩，制酸止痛。